腭舌弓与腭咽弓间的三角形凹陷区
A. 咽隐窝
B. 梨状隐窝
C. 扁桃体窝
D. 咽鼓管咽口
E. 扁桃体小窝

正确答案：C。扁桃体窝

解析：扁桃体窝(C对)为腭舌弓与腭咽弓之间的三角形凹陷区域。